最适合葡萄球菌繁殖并产生毒素的条件是
A. 淀粉含量高
B. 水分含量高
C. 高脂肪
D. 高蛋白
E. 以上都是

正确答案：E。以上都是